男，48岁。发现乙肝肝硬化10年。对该患者动态监测的血清学指标最主要的是
A. AFP
B. 凝血酶原时间
C. 胆红素
D. 血清Ⅲ型前胶原肽
E. HbsAg

正确答案：A。AFP

解析：患者乙肝肝硬化10年，肝硬化的病理基础为肝纤维化，发生机制为反复长期的肝损伤使细胞外基质过量沉积及异常分布，从而导致肝纤维化的发生，引起进行性的肝功能不全、门脉高压症，最终引起肝硬化。血清PⅢP能可靠地反映肝纤维化的程度和活动性及肝脏的组织学改变，是诊断肝纤维化和早期肝硬化的良好指标，但该患者已经肝硬化10年，血清Ⅲ型前胶原肽意义已经不大，要注意向肝癌发展的可能，所以AFP更有意义（A对D错）。AFP为甲胎蛋白，是诊断肝细胞癌的特异性标志物。凝血酶原时间测定和胆红素都能在一定程度上反映肝功能，但不是首选（BC错）。HbsAg（E错）阳性是感染乙肝的标志，该患者已诊断为乙肝肝硬化10年。